牙周刮治前应预防性使用抗生素的是
A. HbAlc为6.5%的患者
B. 有人工心脏瓣膜的患者
C. 伴不稳定型心绞痛的患者
D. 带心脏起搏器的患者
E. 血压在145/90mmHg的患者

正确答案：B。有人工心脏瓣膜的患者

解析：本题考查伴全身疾病患者及特殊人群的牙周治疗-心脑血管疾病患者。牙周刮治前应预防性使用抗生素的是有人工心脏瓣膜的患者（B对）。对于风湿性心脏病、先天性心脏病和有人工心脏瓣膜的患者，在牙周治疗前应预防性使用抗生素，以预防感染性心内膜炎。糖尿病患者HbAlc为6.5%，治疗前不需要使用抗生素（A错）。对有不稳定型心绞痛的患者不宜进行过多的牙周处理，一般仅进行急症处理（C错）。对带心脏起搏器的患者，应判定超声治疗是否干扰起搏器，如无影响，刮治前消除患者紧张情绪，使用咬合垫或其他设备稳定术区，避免意外伤害（D错）。血压在145/90mmHg的患者，牙周治疗同健康人，减少精神压力（E错）。